患者，男，50岁，右臂沿神经干走向出现多个肿块，质软，同时皮肤出现大小不等的咖啡色斑.块应首先考虑的是
A. 皮脂腺囊肿
B. 神经纤维瘤病
C. 皮样囊肿
D. 脂肪瘤
E. 淋巴管瘤

正确答案：B。神经纤维瘤病

解析：本题患者5岁，右臂沿神经干走向出现多个肿块，质软，同时皮肤出现大小不等的咖啡色斑块应首先考虑的是神经纤维瘤病（B对）。皮脂腺囊肿，本病可发生于任何年龄，成人较多见，好发于头面部、肩部及臀部。囊肿可单发或多发，多呈圆形，直径多为1～3cm，略隆起。质软，界清，表面与皮肤粘连、稍可移动，肿物中央皮肤表面可见一小孔，此为腺体导管开口处，有时可见有一黑色粉样小栓，其内容物为灰白色、豆腐渣样物质，有臭味。一般无自觉症状，合并感染时，局部可出现红肿、疼痛、触痛、化脓甚至破溃（A错）。皮样囊肿亦称为先天性包涵体样皮样囊肿，由胚胎期上皮残留而产生，为先天性疾患。本病为先天性囊性肿物，出生时即存在，多在幼儿和青年期发现。好发于眼眶周围、鼻根、枕部和口底等处。囊肿呈界限清楚的黄到淡红色高起结节，质地坚实，有橡皮样硬度，居于皮下组织中，故与表层皮肤无粘连，可自由移动，呈圆球状，直径多为1～4cm，巨大者极少。位于头部的囊肿，常附着于骨膜，有时可向颅内伸展，颅骨可因肿物长期压迫而有小凹陷，严重者可破坏颅骨入颅内，X线摄片可显示颅骨受压或局限性骨质缺损（C错）。脂肪瘤本病可发生于任何年龄，肿瘤可单发或多发，通常质地柔软，呈圆形、扁圆形或分叶状、边界清楚，可以移动。主要见于颈、肩、背、腹部的皮下组织，可对称分布，也可任意分布。大小不一，表面皮肤正常。一般无自觉症状，发展缓慢，极少恶变（D错）。淋巴管瘤，是增生和扩张的淋巴管形成的一种良性肿瘤，其内部充满淋巴液，多见于小儿。可分为毛细淋巴管瘤、海绵状淋巴管瘤和囊性淋巴管瘤。1.毛细淋巴管瘤又称单纯性淋巴管瘤，多发于皮肤，小米至豌豆大小，透明，淡黄色，穿刺有黏液样液体溢出，表面光滑柔软，部分有压缩性。对于瘤体较小且无症状者不必治疗，有症状或瘤体较大者可以手术切除。2.海绵状淋巴管瘤海绵状淋巴管瘤由扩张迁曲的淋巴管组成，其中被较厚的淋巴样间质分隔成柔软的多房性囊肿，多发于皮肤、皮下组织、肌肉结缔组织间隙中，有压迫性。对于范围小者可用硬化剂注射或放射疗法，较大或影响功能才须行手术治疗。3.囊性淋巴管瘤又称水瘤。为充满淋巴液的先天性囊肿，与周围淋巴管不相连，发于颈部为主，可蔓延至胸部，亦可见于其他部位。发生于婴幼儿颈部者即为囊状水瘤。一般为拳头大小，生长缓慢，柔软，囊性，呈分叶状，透光试验阳性。穿刺可抽出草黄色有胆固醇结晶的液体，透明，易凝固，性状与淋巴液完全相同（E错）。